TNT主要损害
A. 晶状体、肝脏、心血管系统、肾脏
B. 晶状体、肝脏、神经系统、消化系统
C. 晶状体、肝脏、 血液系统、消化系统
D. 晶状体、肝脏、血液系统、神经系统
E. 晶状体、肝脏、 血液系统、肾脏

正确答案：D。晶状体、肝脏、血液系统、神经系统

解析：本题考查TNT的损害作用。三硝基甲苯的缩写为TNT。TNT对机体的损害主要有以下几个方面：（1）晶体，晶体损害以中毒性白内障为主要表现；（2）肝脏：肝脏是TNT毒作用的主要靶器官，接触TNT工人早期体征为肝大和（或）脾大；（3）血液系统，TNT可引起血红蛋白、中性粒细胞及血小板减少，也可出现赫恩滋小体，长期高浓度TNT接触可导致再生障碍性贫血；（4）其他，长期暴露TNT的劳动者，类神经综合征发生率增高，并伴有自主神经功能紊乱（D对ABCE错）。